能进入含有结核杆菌的巨噬细胞中，渗入结核菌体，在菌体内特定酶的作用下转化，且在酸性环境中作用更强的抗结核药物是
A. 乙胺丁醇
B. 吡嗪酰胺
C. 利福平
D. 链霉素
E. 异烟肼

正确答案：E。异烟肼

解析：本题考查异烟肼。能进入含有结核杆菌的巨噬细胞中，渗入结核菌体，在菌体内特定酶的作用下转化，且在酸性环境中作用更强的抗结核药物是异烟肼（E对）。异烟肼的抗菌作用机制是抑制分枝菌酸的合成，可被分枝杆菌过氧化氢酶激活，将异烟肼转化为具有酰化能力的活性物质，在结核分枝杆菌的酶系统发挥作用。异烟肼选择性作用于结核分枝杆菌，对静止期结核杆菌有抑制作用，对繁殖期结核杆菌有杀灭作用，因其穿透性强，故对细胞内外的结核杆菌均有作用，是全效杀菌剂。乙胺丁醇（A错）的作用机制可能是与二价离子Mg²⁺结合，干扰细菌RNA的合成。吡嗪酰胺（B错）的作用靶点似乎是参与分枝菌酸生物合成的结核分枝杆菌脂肪酸合成酶Ⅰ基因。利福平（C错）为利福霉素的人工半合成衍生物，抗菌机制为特异性抑制敏感微生物的DNA依赖性RNA多聚酶，阻碍其mRNA的合成。链霉素（D错）主要与细菌核糖体30S亚单位结合，抑制细菌蛋白质的合成，细菌与链霉素接触后极易产生耐药性。